某患者，30岁，11冠折1/4，5年来牙齿无叩痛、无松动，牙齿色泽无改变，X线片示，11根尖无阴影，最适合的治疗方案是
A. 嵌体
B. 3/4冠
C. 塑料全冠
D. 桩核+全冠
E. 金瓷冠

正确答案：E。金瓷冠

解析：本题考查修复体设计。患者，30岁，11冠折1/4（前牙，缺损面积小），5年来牙齿无叩痛、无松动，牙齿色泽无改变，X线片示，11根尖无阴影（无根尖周病变），最适合的治疗方案是金瓷冠（E对）。烤瓷熔附金属全冠兼有金属全冠的强度和烤瓷全冠的美观，其颜色、外观逼真，色泽稳定，表面光滑，耐磨性强，不易变形，抗折力强，具有一定的耐腐蚀性。在前牙用嵌体（A错）修复不利于美观。3/4冠（B错）无法覆盖患牙的全部牙面。塑料全冠（C错）一般用于暂时性修复。桩核+全冠（D错）一般用于牙体缺损较多，剩余牙体组织无法提供足够的抗力的情况下。